农业机械化存在的劳动卫生问题是
A. 噪声和振动
B. 外伤
C. 有毒有害气体
D. 机械化操作时中暑
E. 以上都是

正确答案：E。以上都是